骨折的专有体征是
A. 骨摩擦音
B. 疼痛与压痛
C. 局部肿胀
D. 功能障碍
E. 血运不良

正确答案：A。骨摩擦音

解析：骨折的专有体征有畸形、异常活动及骨摩擦音（A对）或骨摩擦感。疼痛与压痛（B错）、局部肿胀（C错）、功能障碍（D错）及血运不良（E错）均为骨折一般表现，还可见于其他多种疾病，并不是骨折所专有。